下述临终关怀的特点中，正确的是
A. 临终关怀的主要对象为临床患者
B. 临终关怀应积极治疗，不惜一切代价挽救生命
C. 临終关怀应积极治疗，努力延长患者生存时间
D. 临终关怀应提供家庭式的爱抚与关怀
E. 临终关怀由临床医务人员实施，不应吸纳非专业人员参与

正确答案：D。临终关怀应提供家庭式的爱抚与关怀